药物临床试验机构以健康人为麻醉药品和第一类精神药品临床试验的受试对象的，由药品监管管理部门责令停止违潜行为，给予警告；情节严重的，取消其药物临床试验机构的资格；构成犯罪的，依法追究刑事责任。对受试对象造成损害的，药物临床试验机构依法承担治疗和赔偿责任。“对受试对象造成损害的，药物临床试验机构依法承担治疗和赔偿责任”属于
A. 行政处分
B. 民事责任
C. 刑事责任
D. 行政处罚

正确答案：B。民事责任

解析：本题考查的是行政处罚法原则。药物临床试验机构以健康人为麻醉药品和第一类精神药品临床试验的受试对象的，由药品监管管理部门责令停止违潜行为，给予警告；情节严重的，取消其药物临床试验机构的资格；构成犯罪的，依法追究刑事责任。对受试对象造成损害的，药物临床试验机构依法承担治疗和赔偿责任。“对受试对象造成损害的，药物临床试验机构依法承担治疗和赔偿责任”属于民事责任（B对）。行政处罚（D错）的原则：（1）处罚法定原则：依照《中华人民共和国行政处罚法》（以下简称《行政处罚法》），公民、法人或者其他组织违反行政管理秩序的行为，应当给予行政处罚的，由法律、法规或者规章规定，并由行政机关依照《行政处罚法》规定的程序实施。没有法定依据或者不遵守法定程序的，行政处罚无效。（2）处罚公正、公开原则：公正，是指公平、正义，其基本精神是要求行政主体及其工作人员办事公道不徇私情，平等地对待不同身份、民族、性别和不同宗教信仰的人。公正是国家活动的一项基本原则，也是公民所应享有的一项基本权利。在行政处罚中，公平原则要求行政主体必须依法裁判，公平地处罚违法的公民、法人或者其他组织，做到同样的违法行为受到同样的处罚，不同的违法行为不应受到同等的处罚。同时，必须以公正而无偏私的程序达到公正的结果。（3）处罚与违法行为相适应的原则：这一原则是指设定和实施行政处罚必须以事实为依据，与违法行为的事实、性质、情节以及社会危害程度相当。（4）处罚与教育相结合的原则：实施行政处罚，纠正违法行为，应当坚待处罚与教育相结合，教育公民、法人或者其他组织自觉守法。处罚不是目的，而是手段，通过处罚达到教育的目的。（5）不免除民事责任，不取代刑事责任（C错）原则：这一原则是指公民、法人或者其他组织因违法受到行政处罚，其违法行为对他人造成损害的，应当承担民事责任。违法行为构成犯罪，应当依法追究刑事责任，不得以行政处罚代替刑事处罚。行政处分（A错）：指由有管辖权的国家机关或企事业单位依据行政隶属关系对违法失职人员给予的一种行政制裁。其种类主要有警告、记过、记大过、降级、撤职、开除六种。